慢性贫血周围细胞的检查是
A. 外周血白细胞计数高
B. 外周血可见中幼粒晚幼粒细胞
C. 脾大
D. Ph染色体阳性
E. 骨髓检查：粒细胞增生活跃

正确答案：A。外周血白细胞计数高

解析：慢性感染、炎症及肿瘤性疾病所伴有的贫血通常称为慢性贫血。以介导免疫或炎症反应的细胞和细胞因子（如肿瘤坏死因子、白细胞介素-1及干扰素等）产生增多为特征（A对）。中幼粒晚幼粒细胞出现于外周血，说明核左移，见于感染、失血、白血病、类白血病（B错）。脾大见于感染或者非感染因素（淤血、血液病、结缔组织病等）（C错）。Ph染色体阳性（D错）见于慢性髓性白血病患者。骨髓检查粒细胞增生活跃（E错）见于急粒、慢粒，类白血病反应等。